分子结构中17β-羧酸酯基水解成17β-羧酸后，药物活性丧失，也避免了产生皮质激素全身作用的平喘药是
A. 氨茶碱
B. 曲尼司特
C. 孟鲁司特
D. 醋酸氟氢松
E. 丙酸氟替卡松

正确答案：E。丙酸氟替卡松

解析：本题考查糖皮质激素类平喘药。丙酸氟替卡松（E对）是用于控制哮喘症状的糖皮质激素药物，其分子结构中存在17位β羧酸的衍生物。由于仅17位β羧酸酯衍生物具有活性，而β羧酸衍生物不具活性，故丙酸氟替卡松经水解可失活，能避免皮质激素的全身作用。氨茶碱（A错）是茶碱与乙二胺的复盐，其药理作用主要来自茶碱，乙二胺增加其水溶性，可作为注射剂使用。曲尼司特（B错）和孟鲁司特（C错）属于影响白三烯的平喘药，前者是一种过敏介质阻滞剂，体内代谢产物主要是曲尼司特的4位脱甲基与硫酸及葡萄糖醛酸的结合物，后者是选择性白三烯受体的拮抗剂，口服几乎完全被代谢，并全部从胆汁排泄。醋酸氟氢松（D错）由于其抗炎作用增强，水盐代谢作用亦很强，主要外用治疗皮肤病。